关于急性阑尾炎临床表现描述正确的是
A. 都有转移性腹痛
B. 肝下区阑尾炎可刺激泌尿系统引起血尿
C. 坏疽性阑尾炎呈持续性腹痛
D. 阑尾穿孔后腹痛可暂时减轻，体温下降
E. 出现轻度黄疸表明同时合并胆管结石

正确答案：C。坏疽性阑尾炎呈持续性腹痛

解析：急性阑尾炎的典型症状是转移性右下腹疼痛，可见于约70％～80％的病人（A错）。不同类型的阑尾炎其腹痛也有差异，坏疽性阑尾炎呈持续性剧烈腹痛（C对），单纯性阑尾炎表现为轻度隐痛，化脓性阑尾炎为阵发性胀痛和剧痛。阑尾的位置主要取决于盲肠的位置，因此通常阑尾与盲肠一起位于右髂窝内，若盲肠未降至右侧髂窝部而仍在右侧肝下位，则阑尾位于右上腹，炎症时可出现右上腹疼痛，阑尾远端炎症累及输尿管或膀胱时，可出现血尿（B对）。本题BC均对，但参考答案为C。阑尾炎穿孔后因阑尾腔压力骤减，腹痛可暂时减轻，出现腹膜炎后，感染症状加重，体温升高（D错）。急性阑尾炎时，阑尾静脉中的感染性血栓，可沿肠系膜上静脉至门静脉，导致化脓性门静脉炎，临床表现为肝大、剑突下压痛。轻度黄疸等（E错）。